足月婴儿出生时全身皮肤青紫，Apgar评分为3分。查体：昏迷，反射消失，肌张力低下。心率慢，呼吸不规则，诊断为缺氧缺血性脑病，临床分度为
A. 极轻度
B. 轻度
C. 中度
D. 重度
E. 极重度

正确答案：D。重度

解析：重度（D对）缺血缺氧性脑病常表现为昏迷、反射消失、肌张力低下或消失、瞳孔不对称或扩大、并伴有明显的中枢性呼吸衰竭，呼吸不规则。新生儿缺氧缺血性脑病（P100）共分为三级，即轻度、中度、重度。无极轻度（A错）和极重度（E错）。轻度（B错）多表现为意识易激惹、反射多正常、肌张力正常或增加、呼吸活动正常；中度（C错）小儿嗜睡、反射减弱、肌张力减低、存在呼吸活动不规则但不明显。Apgar评分（P97）8～10分为正常，4～7分为轻度窒息，0～3分为重度窒息。